治疗小儿痰热咳嗽，应首选
A. 桑菊饮
B. 清气化痰汤
C. 桑杏汤
D. 金沸草散
E. 桑白皮汤

正确答案：B。清气化痰汤

解析：咳嗽是小儿常见的一种肺系病证，有声无痰为咳，有痰无声为嗽，痰热相结，阻于气道，肺失清肃，则致咳嗽痰多，治以清热化痰，宣肺止咳，方选清金化痰汤、清气化痰汤（B对）。桑菊饮适于风热咳嗽，症见咳嗽不爽，痰黄黏稠（A错）。桑杏汤善于治疗外感温燥证，症见咽干鼻燥，干咳无痰，或痰少而黏，舌红，苔薄白而干（C错）。金沸草散主治风寒感冒，症见咳嗽频作、声重，咽痒，痰白清稀（D错）。桑白皮汤善于肺经热甚，喘嗽痰多等实证（E错）。